对于高血压合并Ⅱ型糖尿病患者，下列药物中有利于延缓糖尿病肾病进展的是
A. 普萘洛尔
B. 吲达帕胺
C. 缬沙坦
D. 硝苯地平
E. 氢氯噻嗪

正确答案：C。缬沙坦

解析：对于高血压合并Ⅱ型糖尿病患者，有利于延缓糖尿病肾病进展的是血管紧张素转换酶抑制剂（ACEI）和血管紧张素Ⅱ受体阻滞剂（ARB）类药物，如：卡托普利、依那普利和缬沙坦（C对）等，因为ACEI和ARB可以使肾小球出、入小动脉扩张，且出球小动脉扩张更明显，故肾小球内压下降，ACEI和ARB也可抑制细胞外基质的产生，从而延缓糖尿病肾病进展。普萘洛尔（A错）属于β受体拮抗剂，主要用于心率较快的中青年患者或合并心绞痛和慢性心力衰竭者，它能增加胰岛素抵抗，还可能掩盖和延长低血糖反应，因此不适用于高血压合并糖尿病患者。硝苯地平（D错）属于钙通道阻滞剂，虽可用于高血压合并Ⅱ型糖尿病患者，但不可延缓糖尿病肾病的进展。吲达帕胺（B错）属于磺胺类利尿剂，氢氯噻嗪（E错）属于噻嗪类利尿剂，二者均禁用于严重肾功能不全患者，因此不适用于糖尿病肾病患者。